下列哪个部位是手阳明大肠经和足阳明胃经的交接处
A. 眶下孔凹陷处
B. 下眼眶缘
C. 鼻翼旁
D. 颧骨旁
E. 口角旁

正确答案：C。鼻翼旁

解析：手阳明大肠经和足阳明胃经在鼻旁交接（C对）。手阳明大肠经起于食指，止于鼻侧。足阳明胃经起于鼻旁，止于大指内侧。因此交于鼻旁。阳明经在鼻旁交接；太阳经在目内眦交接；少阳经在目外眦交接。